月经来潮前性激素的生理变化是
A. 孕激素出现两个高峰
B. 出现雌孕激素高峰
C. 只出现雌激素高峰
D. 只出现孕激素高峰
E. 雌、孕激素均不出现高峰

正确答案：B。出现雌孕激素高峰

解析：此题月经来潮前是指月经来潮前的一个完整月经周期。在一个完整月经周期中，排卵前雌激素出现一次分泌高峰，排卵后第7～8天孕激素达到分泌高峰，雌激素又一次达到高峰。月经来潮前性激素的生理变化是出现雌孕激素高峰（B对CDE错）。一个完整月经周期中孕激素只会出现一个高峰（A错）。